23岁，农民，因发热、头痛、全身酸痛、软弱无力一周于9月4日入院。当天起出现心慌、气促，体温39.6℃。体检：面色苍白，腓肠肌压痛，心率124次/分，呼吸36次/分。肺部散在湿性啰音。血象：血白细胞计数9.0×10⁹/L，中性粒细胞76%，淋巴细胞24%。X线摄片示：两肺纹理增多，有散布性点状阴影。本病例最可能的诊断是
A. 粟粒性肺结核
B. 支气管肺炎
C. 流行性出血热
D. 钩端螺旋体病
E. 急性血吸虫病

正确答案：D。钩端螺旋体病

解析：钩端螺旋体病（P253）的临床表现主要为急性发热，全身酸痛，腓肠肌疼痛与压痛，股骨沟淋巴结肿大，或并发有肺出血、肾损害等。钩端螺旋体的动物宿主十分广泛，带钩体动物排尿污染周围环境，人接触环境中污染的水是本病的主要感染方式。该患者为农民，易接触到被钩端螺旋体病原体污染的环境，且临床表现有发热全身酸痛头痛，腓肠肌明显压痛，故可诊断为钩端螺旋体病（D对）。粟粒性肺结核（A错）常有咳嗽咳痰，长期低热，乏力盗汗等表现，无腓肠肌压痛。支气管肺炎（B错）多见于小儿，急性起病，发热可达40℃以上，常有咳嗽咳痰，喘憋等症状。流行性出血热（C错）又称肾综合征出血热，一种以鼠类为主要传染源的自然疫源性疾病。临床可分为发热期，低血压休克期，少尿期，多尿期，恢复期。其中，发热期可有发热、全身中毒症状（主要表现为头痛、腰痛及眼眶痛“三痛”）、毛细血管损伤和肾损害等表现。急性血吸虫病（P299）（E错）多有明确疫水接触史，临床表现为发热、过敏反应（荨麻疹等）、消化系统症状和肝脾大等。